关于药品质量公告的说法，错误的是
A. 药品质量公告主要是药品质量抽查检验结果的通告
B. 药品质量公告可以指导药品监督管理部门在处理不合格药品，对不合格药品起到控制作用
C. 药品质量公告可以使社会公众了解药品质量状况，引起公众对药品质量的关注和重视
D. 药品质量公告只能由国家药品监督管理部门统一发布

正确答案：D。药品质量公告只能由国家药品监督管理部门统一发布

解析：本题考查的是药品质量公告。药品质量公告是指由国务院和省级药品监督管理部门向公众发布的有关药品质量抽查检验结果的通告（D错，为本题正确答案）。药品质量公告的定义：药品质量公告是指由国务院和省级药品监督管理部门向公众发布的有关药品质量抽查检验结果的通告（A对）。《药品管理法》第101条规定，国务院和省、自治区、直辖市人民政府的药品监督管理部门应当定期公告药品质量抽查检验的结果；公告不当的，应当在原公告范围内予以更正。药品质量公告是药品监督管理的一项重要内容，也是药品监督管理部门的法定义务，药品抽查检验的结果应当依法向社会公告。（2）药品质量公告的作用：药品质量抽验是药品监督管理执法的重点，又是确保药品安全的基础；药品质量公告是药品质量抽验结果的反馈。通过药品质量公告，可以指导药品监督管理部门查处不合格药品，对不合格药品起到控制作用（B对），防止已经出现质量问题、尚未处理的药品再次流入市场，实施对药品质量的后续跟踪管理；同时，向全社会公布药品质量的信息，及时使社会公众了解药品质量的状况，引起公众对药品质量的关注与重视（C对），增强自我保护意识，从而保障公众的健康权益；又使各地各级药品监督管理部门之间实现信息共享，以便通过国家和各省的药品质量公告对本辖区内的药品实现更有针对性、更高效的监管；另外，还起到了对药品生产企业有效的警示作用，促进药品生产企业不断改进生产工艺，提升技术水平，完善质量管理，提高药品质量。